老年性骨质疏松患者，在钙剂+维生素D的基础治疗上，宜选用
A. 雌激素或雌激素受体调节剂
B. 双膦酸盐
C. 降钙素
D. 雄激素
E. 孕激素

正确答案：B。双膦酸盐

解析：本题考查骨质疏松症的药物治疗。老年性骨质疏松患者，在钙剂+维生素D的基础治疗上，宜选用双膦酸盐（B对）组成三联制剂，从而进行骨质疏松的治疗。钙制剂+维生素D+雌激素/选择性雌激素受体调节剂（A错）用于妇女绝经后骨质疏松。降钙素（C错）用于脆性骨折或骨骼变形所致的慢性疼痛以及骨肿瘤等疾病引起的骨痛。